含有氟并具有一定防龋作用的材料是
A. 聚羧酸锌黏固粉
B. 复合树脂
C. 玻璃离子黏固粉
D. 磷酸锌黏固粉
E. 氧化锌丁香油黏固粉

正确答案：C。玻璃离子黏固粉

解析：玻璃离子含有一定的氟离子，能和牙中的羟磷灰石离子相结合，使之再矿化，从而起到防龋的作用。掌握“口腔材料的性能与选择、垫底与暂封材料”知识点。